不存在吸收过程的给药途径是
A. 静脉注射
B. 腹腔注射
C. 肌内注射
D. 口服给药
E. 肺部给药

正确答案：A。静脉注射

解析：本题考查注射给药的给药部位和吸收途径。静脉注射（A对）药物直接进入血液循环，无吸收过程；腹腔注射（B错）药物通过腹膜进入血液循环；肌内注射（C错）经结缔组织扩散；口服给药（D错）药物经胃肠道吸收进入血液循环；肺部给药（E错）药物经肺泡吸收进入血液循环。